牙周膜注射浸润麻醉适用于血友病患者的原因
A. 注射时不痛
B. 注射所致的损伤很小
C. 注射用药量较大故止血好
D. 麻醉效能强度高
E. 麻醉作用时间长

正确答案：B。注射所致的损伤很小

解析：本题考查牙周膜注射法。因血友病患者有凝血功能障碍，应首先考虑的是减少损伤和出血，牙周膜注射浸润麻醉法注射时损伤小（B对），出血少，故可用于血友病和类似的有出血倾向的患者。牙周膜注射法注射时比较疼（A错）。牙周膜注射麻醉可避免因其他浸润麻醉或神经干阻滞麻醉时容易产生的深部血肿，在牙的近中和远中分别注射0.2ml即可麻醉，与注射用药量较大止血好（C错）无关。麻醉效能强度高（D错）、麻醉作用时间长（E错）与适用于血友病患者无关。